中医学称为“刚脏”的是
A. 肝
B. 心
C. 脾
D. 肺
E. 肾

正确答案：A。肝

解析：本题考查的是肝的生理功能。中医学称为“刚脏”的是肝（A对）。肝位于右胁之内，横膈之下。肝具有刚强之性，喜条达舒畅而恶抑郁；内寄相火，主升“刚脏”。心（B错）居于胸腔，横膈之上，有心包卫护于外。心为神之居，血之主，脉之宗，起着主宰生命活动的作用。脾（C错）位于中焦，横膈之下。脾为后天之本，气血生化之源，在志为思，在体为肉，主四肢，开窍于口，其华在唇，在液为涎，与长夏之气相通应，又有“脾寄旺于四时”之说。肺（D错）居胸腔，左右各一，上接气管、喉咙，与鼻相通。在诸脏腑中，肺位最高，故称“华盖”。由于肺叶娇嫩，不耐寒热，易被邪侵，故又称“娇脏”。肾（E错）左右各一，位于腰部，故“腰为肾之府”。肾为先天之本、脏腑阴阳之本。